有关牙槽骨吸收的描述错误的是
A. 牙槽嵴顶到釉牙骨质界的距离超过2mm时，可认为有牙槽骨吸收
B. 牙槽骨吸收可表现为水平型吸收和垂直型吸收
C. 水平型吸收多发生于牙槽间隔较宽的后牙
D. 水平型吸收为牙槽骨高度呈水平状降低
E. 垂直型牙槽骨吸收也称为角形吸收

正确答案：C。水平型吸收多发生于牙槽间隔较宽的后牙

解析：本题考查牙周疾病检查。有关牙槽骨吸收的描述错误的是水平型吸收多发生于牙槽间隔较宽的后牙（C错，为本题正确答案）。前牙因牙槽嵴窄，多呈水平型吸收，垂直型吸收多发生于牙槽间隔较宽的后牙。